患者，男，56岁，咳嗽、咳痰、发热1月余。入院查体：T37.3C，P99次/分，R22次/分，BP123/85mmHg；双肺未闻及明显干、湿性啰音。检查结果：WBC8.06×10⁹/L，N%76.7%，CRP49.06mg/L；肝肾功能正常。肺部CT显示：右肺上叶散在斑片状浸润影。痰涂片可见结核分枝杆菌。诊断为肺结核。该患者选用联合用药方案进行抗结核治疗。下列关于药物不良反应的说法，错误的是
A. 一线抗结核药物多可引起药物性肝损伤
B. 利福平可使体液变成橘红色
C. 异烟肼可引起周围神经病变
D. 吡嗪酰胺可引起球后视神经炎
E. 乙胺丁醇可引起尿酸升高

正确答案：D。吡嗪酰胺可引起球后视神经炎

解析：本题考查抗结核病药的不良反应。吡嗪酰胺不良反应有一般不良反应和严重的不良反应。一般不良反应：痛风、关节痛、恶心、食欲不振、面色潮红、光敏性、短暂轻度氨基转移酶升高；严重的不良反应：药物性肝损伤，皮肤超敏反应，铁粒幼细胞贫血、血小板减少。乙胺丁醇严重的不良反应为球后视神经炎（C错，为本题正确答案）。